伴有炎性肠病、溃疡、胃肠道梗阻和腹部手术史的糖尿病患者，不宜使用的降糖药是
A. 格列美脲
B. 阿卡波糖
C. 二甲双胍
D. 比格列酮
E. 胰岛素

正确答案：B。阿卡波糖

解析：本题考查阿卡波糖。阿卡波糖（B对）的禁忌如下：①对阿卡波糖和（或）非活性成分过敏者禁用；②有明显消化和吸收障碍的慢性胃肠功能紊乱患者禁用；③患有由于肠胀气而可能恶化的疾患（如Roemheld综合症、严重的疝、肠梗阻和肠溃疡）的病人禁用；④严重肾功能损害（肌酐清除率25ml/min）的患者禁用等。格列美脲（A错）不适用于1型糖尿病的治疗，曾有酮症酸中毒病史、糖尿病酮症酸中毒、糖尿病昏迷前期或糖尿病昏迷的病人禁用。二甲双胍（C错）在肾脏疾病或肾功能障碍禁用。吡格列酮（D错）禁用于对本品以及本品中任何成分过敏的病人，现有或既往有膀胱癌病史的患者或存在不明原因的肉眼血尿的患者禁用本品。胰岛素（E错）不适用于低血糖症、胰岛细胞瘤、对胰岛素过敏者。